易发生蒂扭转的卵巢囊肿是
A. 皮样囊肿
B. 巧克力囊肿
C. 粘液性囊腺瘤
D. 浆液性囊腺癌
E. 滤泡囊肿

正确答案：A。皮样囊肿

解析：蒂扭转为常见的妇科急腹症，好发于瘤蒂较长、中等大、活动度良好、重心偏于一侧的肿瘤，如皮样囊肿（成熟畸胎瘤）（A对）。巧克力囊肿（P270）（B错）是异位内膜侵犯卵巢皮质并反复出血形成的囊肿，活动性差，不易发生蒂扭转。黏液性囊腺瘤（P326）（C错）多为单侧，圆形或卵圆形，体积较大，多房，囊腔内充满胶冻样黏液；浆液性囊腺癌（P326）（D错）多为双侧，体积较大，囊实性，多房，腔内充满乳头，两者体积较大，不易发生蒂扭转。滤泡囊肿（第二版实用妇产科学P681）（E错）一般无临床症状，多在妇科检查和B超检查时发现，罕有扭转或破裂者。